关于难免流产哪项是错误的
A. 阴道流血增加
B. 下腹痛加剧
C. 有部分胎盘嵌顿于宫颈口，部分胎盘排出
D. 宫口开
E. 子宫体与孕周相符或略小于孕周

正确答案：C。有部分胎盘嵌顿于宫颈口，部分胎盘排出

解析：本题选C。错在“部分胎盘排出”。难免流产：妇科检查宫颈口已扩张，有时可见胚胎组织或胎囊堵塞于宫颈口内，子宫大小与停经周数相符或略小。掌握“自然流产”知识点。